男，35岁。近3个月来经常感到不明原因的紧张、害怕，对生活中的琐事思虑过度，自己不能控制，为此感到苦恼，坐立不安，主动就诊。患者存在的主要症状是
A. 恐惧症状
B. 惊恐发作
C. 强迫症状
D. 焦虑症状
E. 强制思维

正确答案：D。焦虑症状

解析：该患者近3个月来经常感到不明原因的紧张害怕（缺乏客观刺激情况下表现为紧张害怕），对生活中的琐事思虑多（顾虑重重），坐立不安为焦虑症状（D对）。焦虑障碍和强迫障碍都会焦虑表现，焦虑障碍无焦虑对象，强迫障碍患者的强迫观念和行为常源自于患者的主管提源，其回避与强迫行为和强迫思维有关，本例中更主要的症状是焦虑症状（C错）。恐惧症和广泛性焦虑障碍都以焦虑为核心症状，但恐惧症的焦虑由特定的对象或处境引起，呈境遇性和发作性，而焦虑障碍的焦虑常没有明确的对象，常持续存在（A错）。惊恐发作的患者常突然发作、强烈的惊恐体验伴濒死感，与本例不符（B错）。